男，50岁。面色苍白、乏力半年，牙龈出血1周。化验血常规：Hb72g/L，WBC2.8X10⁹/L，Plt32X10⁹/L。骨髓细胞学检查：增生明显活跃，原始细胞占0.02，全片见巨核细胞40个，铁染色示细胞外铁（＋＋），环形铁粒幼细胞占0.01，诊断为骨髓增生异常综合征（MDS）根据WHO分型标准，还需要进行的检查项目是
A. 骨髓细胞染色体
B. 骨髓活检
C. 骨髓细胞流式细胞术
D. 骨髓细胞融合基因
E. 骨髓干细胞培养

正确答案：B。骨髓活检

解析：根据MDS2016年WHO修订分型，该分型包括项目病态造血系数（红系、白系、血小板系）、细胞减少系数、环形铁粒幼细胞%，骨髓和外周血原始细胞和常规核型分析，为明确骨髓造血组织的结构、增生程度、细胞成分及形态变化，需行骨髓活检（B对）。骨髓细胞染色体检测，即染色体核型分析，常用于确诊染色体病或者诊断特殊疾病的遗传学特征变化，如慢性髓系白血病的Ph染色体（A错）。骨髓细胞融合基因的检测多用于恶性肿瘤的诊断，如急性早幼粒细胞白血病（PML-RARA融合基因检测阳性），慢性髓系白血病（BCR-ABL融合基因检测阳性），早期肺癌（ROSl融合基因重排）（D错）。根据9版内科学教科书MDS2016年WHO修订分型可见不包括骨髓细胞流式细胞术、骨髓干细胞培养（CE错）。